导致口腔颌面部感染的病原菌主要为
A. 金黄色葡萄球菌、溶血性链球菌、绿脓杆菌
B. 金黄色葡萄球菌、溶血性链球菌、大肠杆菌
C. 金黄色葡萄球菌、绿脓杆菌、大肠杆菌
D. 金黄色葡萄球菌、溶血性链球菌、变形杆菌
E. 金黄色葡萄球菌、变形杆菌、大肠杆菌

正确答案：B。金黄色葡萄球菌、溶血性链球菌、大肠杆菌

解析：口腔颌面部感染常由金黄色葡萄球菌、溶血性链球菌、大肠杆菌等引起。掌握“口腔颌面部感染概论”知识点。